下列哪些化学物质易于从呼吸道进入机体
A. 苯
B. CO
C. SO₂
D. 粉尘
E. 以上都是

正确答案：E。以上都是